性温，能祛风湿、强筋骨、利水消肿的中药是
A. 络石藤
B. 臭梧桐
C. 穿山龙
D. 青风藤
E. 香加皮

正确答案：E。香加皮

解析：本题考查香加皮的功效。性温，能祛风湿、强筋骨、利水消肿的中药是香加皮（E对）。香加皮【功效】祛风湿，强筋骨，利水消肿。络石藤（A错）【功效】祛风通络，凉血消肿。臭梧桐（B错）【功效】祛风湿，通经络，降血压。穿山龙（C错）【功效】祛风除湿，活血通络，化痰止咳。青风藤（D错）【功效】祛风湿，通经络，利小便。